软胶囊剂常用的制备方法是
A. 挤出滚圆法
B. 压制法
C. 复凝聚法
D. 液中析晶法
E. 融熔法

正确答案：B。压制法

解析：本题考查软胶囊剂的制备方法。软胶囊剂的制备方法常用滴制法和压制法（B对）。挤出滚圆法（A错）是小丸常用的制备方法。复凝聚法（C错）是微囊的制备方法。液中析晶法（D错）是制粒方法。融熔法（E错）是固体分散体的制备方法。